临床上去除龋坏组织的标准主要根据
A. 洞壁牙体组织的颜色深浅
B. 洞壁牙体组织的硬度
C. 洞底的位置
D. 预计剩余牙体组织的多少
E. 患者的敏感程度

正确答案：B。洞壁牙体组织的硬度

解析：本题考查去除龋损组织的标准。临床上去除龋坏组织的标准主要根据洞壁牙体组织的硬度（B对）。临床一般根据牙本质的硬度和着色两个标准来判断龋坏组织是否去净（CDE错）。慢性龋进展缓慢，修复反应强，早期病变组织可重新矿化，此种再矿化牙本质颜色较正常牙本质深，但质硬，应予以保留，故洞壁牙体组织的颜色深浅不能作为去除龋坏组织的主要标准（A错），临床上去除龋坏组织的标准主要根据洞壁牙体组织的硬度。